主治热毒痢疾的方剂是
A. 败毒散
B. 芍药汤
C. 白头翁汤
D. 葛根芩连汤
E. 真人养脏汤

正确答案：C。白头翁汤

解析：主治热毒痢疾的是白头翁汤，本方是因热毒深陷血分，下迫大肠所致，治以清热解毒，凉血止血（C对）。败毒散主治气虚，外感风寒湿表证（A错）。芍药汤主治湿热痢疾（B错）。葛根芩连汤主治协热下利（D错）。真人养脏汤主治久泻久痢，脾肾虚寒证（E错）。